关于我国预防控制策略的描述，不正确的是
A. 策略是指导全局的总体方针
B. 疾病预防要贯彻现代医学模式为指导的策略
C. 要从医学预防走向社会预防
D. 为人民健康服务
E. 以治疗为主

正确答案：E。以治疗为主